药物在体内经代谢，R-对映体可转化为S-对映体的是
A. 贝诺酯
B. 对乙酰氨基酚
C. 安乃近
D. 双氯芬酸纳
E. 布洛芬

正确答案：E。布洛芬

解析：本题考查药物的手性特征及其对药物作用的影响。布洛芬（E对）在体内经代谢，R-对映体可转化为S-对映体。贝诺酯（A错）无对映异构体，代谢产物为水杨酸和对乙酰氨基酚；对乙酰氨基酚（B错）大部分在肝脏代谢，以葡萄糖醛酸结合物形式从肾脏排泄；安乃近（C错）无对映异构体，水溶性强，代谢快；双氯芬酸钠（D错）无对映异构体，代谢途径为苯环氧化。